采购第二类疫苗，可以通过（）渠道进行采购
A. 省级共用资源交易平台
B. 疫苗批发企业
C. 疫苗接种点
D. 政府
E. 药店

正确答案：A。省级共用资源交易平台